下列哪项不属于霍乱弧菌的致病物质
A. 鞭毛
B. 菌毛
C. 毒素共调菌毛
D. 外毒素
E. 内毒素

正确答案：E。内毒素

解析：本题考查霍乱弧菌的致病物质。内毒素（E错，为本题的正确答案）是革兰阴性菌细胞壁的脂多糖，当菌体死亡崩解后游离出来的物质。霍乱弧菌的致病物质包括鞭毛（A对）、菌毛（B对）、毒素共调菌毛（C对）、外毒素（D对）等。